女，28岁，既往月经规律，现停经45天，发现阴道流出少量咖啡色物2天，无腹痛，尿hCG（+）。目前首先考虑的诊断可能为
A. 难免流产
B. 先兆流产
C. 完全流产
D. 不全流产
E. 感染流产

正确答案：B。先兆流产

解析：育龄期女性，既往月经规律，现停经45天，尿hCG（＋），考虑早期妊娠。难免流产指流产不可避免，在先兆流产基础上，阴道流血量增多，阵发性下腹痛加剧，或出现阴道流液（A错）。先兆流产指妊娠28周前出现少量阴道流血，常为暗红色或血性白带，发现阴道流出少量咖啡色物2天，提示阴道少量流血（B对）。不全流产指难免流产继续发展，部分妊娠物排除宫腔，还有部分残留于宫腔内或嵌顿于宫颈口处，或胎儿排出后胎盘滞留宫腔或嵌顿于宫颈口，影响子宫收缩，导致大量出血，甚至发生休克（D错）。